下列关于工业通风论述错误的是
A. 主要作用在于排出作业地带尘、毒污染的或潮湿、过热或过冷的空气，送入清洁空气
B. 是降低车间空气中尘、毒污染的唯一有效措施
C. 使用前后工作地点空气中有害物浓度变化可作为效果评价内容
D. 效果评价应检查其设计、安装和使用是否合理
E. 安全性和有无不良影响也应是效果评价内容

正确答案：B。是降低车间空气中尘、毒污染的唯一有效措施